药物稳定性加速试验法是
A. 温度加速试验法
B. 湿度加速试验法
C. 空气干热试验法
D. 光加速试验法
E. 隔绝空气试验法

正确答案：A、B。温度加速试验法；湿度加速试验法

解析：本题考查药物稳定性试验方法。药物稳定性加速试验法包括：温度加速试验法（A对）、湿度加速试验法（B对）。实验条件：温度 40°C± 2°C相对湿度 75% ±5 %的条件下放置6个月。检测包括初始和末次的3个时间点（如0、3、6个月）。加速试验对光照无特殊要求（D错）。空气干热试验法（C错）和隔绝空气试验法（E错）均不用于加速试验。